服用叶酸治疗巨幼红细胞性贫血，需同时联合使用的药品是
A. 维生素B₁
B. 维生素B₂
C. 维生素B₁₂
D. 依诺肝素
E. 酚磺乙胺

正确答案：C。维生素B₁₂

解析：本题考查药物的联合应用。叶酸可改善巨幼红细胞性贫血，但不能阻止因维生素B₁₂缺乏所致的神经损害，宜同时服用维生素B₁₂（C对）改善神经症状。